初孕妇，26岁。于妊娠34周出现头痛眼花。血压180/100mmHg，尿蛋白（++），眼底动静脉比为1：2，视网膜水肿。本例诊断应是
A. 中度妊高征
B. 先兆子痫
C. 子痫
D. 妊娠合并原发性高血压
E. 妊娠合并肾性高血压

正确答案：B。先兆子痫

解析：26岁初孕妇，于妊娠34周出现头痛眼花（重度子痫前期可有持续头痛或视觉障碍或其它脑神经症状），血压180/100mmHg（重度子痫前期收缩压≥160mmHg和（或）舒张压≥110mmHg），尿蛋白（++）（子痫前期尿蛋白阳性），眼底动静脉比为1：2，视网膜水肿（正常视网膜动静脉直径比值为2/3，子痫前期患者因高血压引起视网膜动脉痉挛、变窄，眼底检查可见视网膜动静脉比值1:2以上、视乳头水肿），该患者应诊断为先兆子痫（重度子痫前期）（B对）。按照实用妇产科学第2版P199，妊高征分为轻、中、重度。轻度妊高征时血压≥140/90mmHg，或较基础血压升高30/15mmHg，可伴轻度的蛋白尿和（或）水肿；中度妊高征（A错）时140mmHg＜收缩压＜160mmHg，90mmHg＜舒张压＜110mmHg，尿蛋白（+），或伴水肿，无自觉症状。重度妊高征包括先兆子痫和子痫。子痫（C错）是在先兆子痫（重度子痫前期）的基础上发生了不明原因的抽搐。妊娠合并原发性高血压（D错）从妊娠20周前即有血压升高，妊娠期无明显加重，而该患者高血压出现于妊娠34周。妊娠合并肾性高血压（E错）往往在发现血压升高时已有蛋白尿、血尿和贫血、肾功能减退，尿沉渣镜检异常。